原卫生部于2010年颁布了《全国健康教育专业机构工作规范》，该规范规定了健康教育专业机构的职责，除外
A. 技术咨询与政策建议
B. 业务指导与人员培训
C. 总结与推广适宜技术
D. 信息管理与发布
E. 调整卫生服务方向

正确答案：E。调整卫生服务方向